患者突然出现右半身活动不利，舌强语謇，兼眩晕头痛，烦躁，舌红，苔黄，脉弦而有力针灸治疗除主穴外，应加用
A. 丰隆、合谷
B. 曲池、内庭
C. 太冲、太溪
D. 足三里、气海
E. 太溪、风池

正确答案：C。太冲、太溪

解析：患者突然出现右半身活动不利，舌强语謇，为中风之象，而眩晕头痛，烦躁，舌红，苔黄，脉弦为肝阳上亢之象，故为肝阳上亢，扰乱清窍所致中风。太冲穴平肝息风，清泻肝火，以制肝阳。太溪穴滋阴益肾，滋肾水以制肝阳（C对）。